因新生儿肝酶发育不全，可造成灰婴综合征的是
A. 四环素
B. 氯霉素
C. 链霉素
D. 庆大霉素
E. 黄连素

正确答案：B。氯霉素